子宫内膜异位症常见侵犯的部位是
A. 卵巢
B. 脐
C. 膀胱
D. 肾
E. 肺

正确答案：A。卵巢

解析：子宫内膜异位症可侵犯全身任何部位，如脐（B错）、膀胱（C错）、肾（D错）、输尿管、肺（E错）、胸膜、乳腺，甚至手臂、大腿等处，其中以卵巢（A对）和宫骶韧带为常见。